与藜芦相反的药有
A. 甘遂
B. 京大戟
C. 苦参
D. 细辛
E. 白蔹

正确答案：C、D。苦参；细辛